H₁受体阻断药对哪种病最有效
A. 支气管哮喘
B. 皮肤黏膜过敏症状
C. 血清病高热
D. 过敏性休克
E. 过敏性紫癜

正确答案：B。皮肤黏膜过敏症状